患儿，2岁。上前牙唇面广泛性龋坏，牛奶喂养，未刷过牙，诊断为
A. 静止龋
B. 湿性龋
C. 慢性龋
D. 奶瓶龋
E. 猖獗性龋

正确答案：D。奶瓶龋

解析：本题考查奶瓶龋的诊断。患儿2岁，上前牙唇面广泛性龋坏，牛奶喂养，未刷过牙，综合考虑，诊断为奶瓶龋（D对）。喂养龋：由于不良喂养习惯引起的早期广泛性龋齿，如含奶瓶入睡，睡前喝奶后不刷牙，牙齿萌出后夜间喝奶，延长母乳和奶瓶喂养时间，过多进食含糖饮料饮食等。表现为好发于上颌切牙的唇面，而在下颌切牙却无龋齿，也称奶瓶龋。静止龋（arrestedcaries）（A错）指在牙冠广泛崩坏时，龋损可以停止进展，表面硬化、光洁，呈暗褐色，而牙髓仍属正常。急性龋又称湿性龋（B错），多见于儿童和青少年，龋病进展快速，龋洞湿软，呈棕黄色，较易用刮匙刮除，修复性牙本质形成较少。慢性龋（C错）则与之相反，病变时间长，质地坚硬，颜色深黑，用刮匙难以去除。猖獗性龋（E错）指口腔短期内（6－12个月）同时有多个牙齿、多个牙面，尤其是一般不发生龋的下颌前牙，发生龋。